2017年1月21日，国务院发布《第三批取消中央指定地方实施行政许可事项的决定》（国发〔2017〕7号），其中取消了互联网药品交易服务企业审批（第三方平台除外）行政许可事项。2017年9月29日，《国务院关于取消一批行政许可事项的决定》（国发〔2017〕46号）发布，决定取消互联网药品交易服务企业（第三方平台）审批的行政许可事项。2017年11月1日，国家食品药品监合管理总局发布《总局办公厅关于加强互联网药品医疗器械交易监管工作的通知》（食药监办法〔2017〕144号），就加强互联网药品、医疗器械交易监管工作，做好相关事中事后监督管理措施的衔接工作，作出了明确规定。上述信息中提到的“第三方平台”从事的服务是指
A. 向个人消费者提供的互联药品交易服务
B. 为药品生产企业、经营企业和医疗机构之间的互联网药品交易提供的服务
C. 通过互联网向上网用户提供的药品（含医疗器械信息服务）
D. 药品生产企业、药品批发企业通过自身网站与本企业成员之外的其他企业互联网药品交易的

正确答案：B。为药品生产企业、经营企业和医疗机构之间的互联网药品交易提供的服务

解析：本题考查的是网络药品交易服务的类型。2017年1月21日，国务院发布《第三批取消中央指定地方实施行政许可事项的决定》（国发〔2017〕7号），其中取消了互联网药品交易服务企业审批（第三方平台除外）行政许可事项。2017年9月29日，《国务院关于取消一批行政许可事项的决定》（国发〔2017〕46号）发布，决定取消互联网药品交易服务企业（第三方平台）审批的行政许可事项。2017年11月1日，国家食品药品监合管理总局发布《总局办公厅关于加强互联网药品医疗器械交易监管工作的通知》（食药监办法〔2017〕144号），就加强互联网药品、医疗器械交易监管工作，做好相关事中事后监督管理措施的衔接工作，作出了明确规定。上述信息中提到的“第三方平台”从事的服务是指为药品生产企业、经营企业和医疗机构之间的互联网药品交易提供的服务（B对）。网络药品交易服务的类型：1.企业对企业模式（B-to-B）：药品上市许可持有人、药品批发企业通过自建网站，从网上采购药品或将药品销售给其他药品上市许可持有人、药品生产企业、药品经营企业和药品使用单位，以及药品零售企业、医疗机构从网上向药品上市许可持有人、药品批发企业采购药品的网络药品交易服务模式（D错）。药品上市许可持有人、药品批发企业通过网络销售药品的，应当按规定向所在地省级药品监督管理部门备案。2.企业对个人消费者模式（B-to-C）：药品零售企业通过自建网站，向个人消费者销售药品，并按照药品GSP要求配送至个人消费者的网络药品交易服务模式（A错）。药品零售企业通过网络销售药品的，应当按规定向所在地市县级药品监督管理部门备案。3.药品网络交易第三方平台模式：药品网络交易第三方平台提供者通过网络系统，为在药品网络交易活动中的购销双方提供网络药品交易服务的模式。4.线上与线下联动模式（O-to-O）：（1）“网订店取”，个人消费者通过网络下单购买药品，赴就近的药品零售企业经营场所获取药品和相关药学服务。（2）“网订店送”，个人消费者通过网络下单购买药品，由药品零售企业的执业药师或其他药学技术人员按照药品GSP配送药品的要求，将购买的药品送递至个人消费者，并当面向其提供相关药学服务。国家鼓励药品零售企业向个人消费者提供“网订店取”“网订店送”模式的网络药品交易服务。互联网药品信息服务，是指通过互联网向上网用户提供药品（含医疗器械）信息的服务活动（C错）。